免疫球蛋白的功能区轻链的两个功能区是
A. VL、CL
B. VH、CH1
C. CH1、CH2
D. CH2、CH3
E. IgM、CH3

正确答案：A。VL、CL

解析：免疫球蛋白的功能区：Ig通过折叠可形成若干球形结构域，这些结构域是Ig的功能区。轻链有VL和CL两个功能区。掌握“免疫球蛋白基本概念及结构”知识点。